8岁患者，跌倒致右上1牙冠斜折，即刻来院就诊。口腔检查见穿髓孔大，叩（+）。首选治疗为
A. 活髓切断术
B. 根尖诱导成形术
C. 干髓术
D. 直接盖髓术
E. 根管治疗术

正确答案：A。活髓切断术

解析：本题考查年轻恒牙活髓保存治疗。如露髓的时间比较长，发生牙髓弥漫性感染，甚至牙髓坏死，应该去除感染牙髓，治疗中应注意尽可能多地保存活的根髓和根尖牙乳头，使牙根继续发育，可行根尖诱导成形术，应在冠髓切断术后进行根尖诱导成形术（A对B错）。干髓术是去除感染的冠髓，保留干尸化的根髓，保存患牙的治疗方法，适用于成年人后牙（C错）。直接盖髓术适用于机械性或外伤性露髓，露髓孔应小于1mm（D错）。年轻恒牙根尖孔未闭合，不能行根管治疗术（E错）。